在不同pH介质中皆有表面活性的两性离子表面活性剂是
A. 硬脂酸钠
B. 苯扎溴铵
C. 卵磷脂
D. 聚乙烯醇
E. 聚山梨酯80

正确答案：C。卵磷脂

解析：本题考查表面活性剂。卵磷脂（C对）是一种在不同pH介质中皆有表面活性的两性离子表面活性剂，两性离子表面活性剂系指分子中同时具有正、负电荷基团的表面活性剂。硬脂酸钠（A错）为阴离子表面活性剂。苯扎溴铵（B错）为阳离子表面活性剂。聚乙烯醇（D错）为高分子表面活性剂。聚山梨脂80（E错）为非离子表面活性剂。